分布到脐平面的胸神经前支为
A. T4
B. T6
C. T8
D. T10
E. T12

正确答案：D。T10

解析：分布到脐平面的胸神经前支为T10（D对）。T4（A错）分布到乳头平面；T6（B错）分布到剑突平面；T8（C错）分布到两侧肋弓中点连线的平面；T12（E错）分布到脐与耻骨联合连线中点的平面。